女，28岁，初产妇。妊娠39周，规律宫缩10小时，查宫口扩张6cm，LOA，胎先露S=+1，胎心140次/分，胎儿监护NST有反应型。需要进一步的处理是
A. 催产素加强宫缩
B. 给予宫颈封闭
C. 肌注哌替啶
D. 严密观察产程
E. 超声评估胎儿大小

正确答案：D。严密观察产程

解析：成年女性患者，初产妇。妊娠39周，规律宫缩10小时（子宫节律性收缩是临产的重要标志），查宫口扩张6cm（正常值＜4cm），LOA，胎先露S=+1（胎先露下降在坐骨棘下1cm），胎心140次/分（正常值110～160次/分），胎儿监护NST有反应型（提示胎儿中枢神经系统发育良好）。综合患者的症状、体征和辅助检查，初步诊断为临产开始，需要进一步的处理是严密观察产程（D对）。催产素加强宫缩（A错）、给予宫颈封闭（B错）适用于子宫收缩乏力的患者。肌注哌替啶（C错）适用于非协调性子宫收缩乏力。超声评估胎儿大小（E错）适用于产前随诊。